紫外线照射（1W/m³）进行室内空气消毒需要多长时间
A. 10～30分钟
B. 20～40分钟
C. 30～60分钟
D. 40～80分钟
E. 60～90分钟

正确答案：C。30～60分钟

解析：本题考查紫外线照射（1W/m³）进行室内空气消毒需要的时间。紫外线照射（1W/m³）进行室内空气消毒需要30～60分钟（C对ABDE错）。